AIDS并发机会性感染和恶性肿瘤的机制主要是
A. 细胞免疫受损
B. 体液免疫受损
C. 非特异性免疫受损
D. 特异性免疫受损
E. 脾脏受损

正确答案：A。细胞免疫受损

解析：通过表面CD4分子，HIV感染单核-吞噬细胞使其抗感染能力减弱，并透过血脑屏障，引起中枢神经系统的感染。HIV 感染B淋巴细胞，使其出现多克隆化，循环免疫复合物和外周血B淋巴细胞增高，对新抗原刺激的反应能力降低。HIV感染者早期的自然杀伤细胞（NK细胞）数量减少，监视功能被抑制，致AIDS患者容易出现肿瘤（A对）。